发出分支至肾上腺的血管是
A. 腰动脉
B. 膈下动脉
C. 肠系膜上动脉
D. 脾动脉
E. 腹腔干

正确答案：B。膈下动脉

解析：膈下动脉（B对）发出分支肾上腺上动脉至肾上腺。